甘草中具有镇痉、抗溃疡作用的成分主要是
A. 黄酮类
B. 三萜皂苷类
C. 香豆素类
D. 生物碱类
E. 挥发性成分

正确答案：A。黄酮类

解析：本题考查的是甘草的主要成分。甘草中具有镇痉、抗溃疡作用的成分主要是黄酮类（A对）。甘草的药理作用（1）抗溃疡甘草粉、甘草浸膏、甘草次酸、甘草素、甘草苷、异甘草苷对多种实验性溃疡模型均有抑制作用，能促进溃疡愈合。（2）镇咳、祛痰甘草能促进咽喉和支气管黏膜的分泌，呈现祛痰镇咳的作用。甘草流浸膏、甘草次酸、甘草黄酮均有镇咳、祛痰作用。三七中的主要化学成分是三萜皂苷类（B错），含量高达12%。三七的药理作用（1）止血三七具有较强的止血作用。三七粉、三七注射液、三七氨酸可缩短出血时间、凝血时间和凝血酶原时间，增加血小板数量和功能，增加凝血酶含量，促进纤维蛋白形成，收缩局部血管。（2）抗血栓三七、三七总皂苷可抑制血小板聚集，激活尿激酶，促进纤维蛋白溶解。肿节风主要含有酚类、鞣质、黄酮苷、香豆素和内酯类化合物。其中香豆素类（C错）主要包括异嗪皮啶、东莨菪内酯等。药理实验已经证明这些化学成分（或有效部位）本身具有一定的抗菌、抗炎、镇痛和抗肿瘤活性。苦参所含主要生物碱（D错）是苦参碱和氧化苦参碱。苦参总生物碱具有抗肿瘤、抗病原微生物、抗心律失常、解热、抗炎、抗变态反应和调节免疫等作用。肉桂皮含挥发油（E错）1%～2%。肉桂具有抗消化性溃疡、止泻、利胆作用，也有降血糖、降血脂等作用。肉桂中原花青素成分具有抗糖尿病的药理作用。